鉴别非典型苯丙酮尿症，需进行
A. Guthrie细菌生长抑制试验
B. 尿蝶呤分析
C. 尿有机酸分析
D. 尿三氯化铁试验
E. 尿2，4-二硝基苯肼试验

正确答案：B。尿蝶呤分析

解析：尿蝶呤分析是指应用高效液相色谱测定尿液中新蝶呤（N）和生物蝶呤（B）的含量，主要用于苯丙酮尿症（PKU）分型的鉴别（B对），苯丙氨酸羟化酶缺乏所致的经典型PKU，表现为尿中蝶呤总量增高，N/B正常；三磷酸鸟苷环化水解酶（GTP～CH）缺乏型PKU，表现为尿中蝶呤总量减少，N/B正常；6-丙酮酰四氢蝶呤合成酶（PTPS）缺乏型PKU，表现为新蝶呤排出量增加，N/B增高；二氢生物蝶呤还原酶（DHPR）缺乏型PKU，表现为尿中蝶呤总量增高，N/B降低。Guthrie细菌生长抑制试验主要用于新生儿PKU筛查（A错）。尿有机酸分析主要用于PKU的生化诊断（C错）。尿三氯化铁试验、2，4—二硝基苯肼试验主要用于较大儿童PKU的筛查（DE错）。